男性，35岁，因车祸右小腿受伤，经拍X线片，诊断为右胫骨中下1/3交界处斜型骨折，其易发生
A. 骨筋膜室综合征
B. 脂肪栓塞
C. 延迟愈合或不愈合
D. 血管损伤
E. 神经损伤

正确答案：C。延迟愈合或不愈合

解析：胫骨不同部位的骨折并发症总结：胫骨上1/3骨折易损伤胫后动脉而致下肢缺血坏死（D错），胫骨中1/3骨折易发生骨筋膜室综合征（A错），胫骨中下1/3骨折易并发骨折延迟愈合或不愈合（C对）。腓骨颈骨折易并发腓总神经损伤（E错）。脂肪栓塞（B错）为骨折早期并发症，多见于股骨干骨折。